十二经筋的分布，多结聚于
A. 胸腹部
B. 肌肤体表部位
C. 关节和骨骼附近
D. 四肢末端
E. 头面及项部

正确答案：C。关节和骨骼附近

解析：该题主要考察十二经筋的分布。十二经筋的分布，与十二经脉在体表的循行基本一致，循行分布一般都在肢体部，从四肢末端走向头身，行于体表，结聚于关节、骨骼附近（C对）。